能发生硫色素特征反应的药物是
A. 维生素A
B. 维生素B₁
C. 维生素C
D. 维生素E
E. 烟酸

正确答案：B。维生素B₁

解析：本题考查常用的药品鉴别方法。能发生硫色素特征反应的药物是维生素B₁（B对）。维生素B₁在碱性条件下与铁氰化钾反应生成具有蓝色荧光的硫色素。维生素A（A错）可与三氯化锑反应显色。维生素C（C错）可使二氯靛酚钠试液褪色。维生素E（D错）的鉴别反应包括：与硝酸的反应、红外分光光度法和高效液相色谱法。烟酸（E错）属于维生素B₃，在碳酸钠试液或氢氧化钠试液中易溶。